男，25岁。主因右膝关节肿痛2周就诊，腰痛3年。查体：右膝关节肿胀，有压痛，浮髌实验阳性，左侧“4字征”阳性，左侧骶髂关节压痛。检查类风湿因子、抗“O”抗体均阴性，血沉28mm/小时，HLA-B27阳性。骶髂关节X线片提示：左侧间隙狭窄，边缘不整，可见骨破坏。最可能诊断是
A. 类风湿关节炎
B. 骨关节炎
C. 风湿性多肌炎
D. 化脓性关节炎
E. 强直性脊柱炎

正确答案：E。强直性脊柱炎

解析：强直性脊柱炎主要表现为下腰痛伴晨僵，常见体征为骶髂关节压痛，浮髌试验阳性，血沉加快，HLA-B27阳性，X线表现为骨关节局限性侵蚀、硬化，伴或不伴关节间隙增宽或狭窄。患者临床表现及实验室检查与强直性脊柱炎相符，故该患者最可能的诊断是强直性脊柱炎（E对）。类风湿关节炎（P808）主要表现为晨僵、关节痛和压痛、关节肿、关节畸形，类风湿因子阳性（A错）。骨关节炎（P858）主要表现为关节痛、晨僵、关节摩擦感，血沉大多正常（B错）。风湿性多肌炎主要表现为近端肌肉无力、特征性皮疹，血沉常增快（C错）。化脓性关节炎（九版外科学P746）主要表现为寒战、高热，病变关节迅速出现疼痛与功能障碍，血白细胞增高，血沉增快（D错）。